牙列缺损Kennedy分类第一类
A. 单侧游离端缺失
B. 双侧游离端缺失
C. 单侧非游离端缺失
D. 双侧非游离端缺失
E. 前牙缺失

正确答案：B。双侧游离端缺失

解析：本题考查Kennedy牙列缺损分类。属于Kennedy分类的第一类的是双侧游离端缺失（B对），属于Kennedy分类的第二类的是单侧游离端缺失（A错），属于Kennedy分类的第三类的是单侧非游离端缺失（C错），属于Kennedy分类的第四类的是前牙缺失（E错）且跨过中线。而双侧非游离端缺失（D错）则属于第三类一亚类。